下列关于生物医学研究伦理的知情同意原则错误的是
A. 项目研究者开展研究，应当获得受试者自愿签署的知情同意书
B. 对无行为能力、限制行为能力的受试者，项目研究者应当获得其监护人或者其法定代理人的书面知情同意
C. 知情同意书必须是书面的
D. 研究方案、范围、内容发生变化的需要再次获取受试者的知情同意
E. 利用可识别身份信息的人体材料或数据进行研究的无需签署知情同意

正确答案：C。知情同意书必须是书面的